评价药物安全性的药物治疗指数可表示为
A. ED₉₅/LD₅
B. ED₅₀/LD₅₀
C. LD/ED₉₉
D. LD₅₀/ED₅₀
E. ED₉/LD₁

正确答案：D。LD₅₀/ED₅₀

解析：本题考查药物的治疗指数。评价药物安全性的药物治疗指数可表示为LD₅₀/ED₅₀（D对）。药物的安全性一般与其LD₅₀的大小成正比，与ED₅₀成反比，故常以药物LD₅₀和ED₅₀的比值表示药物的安全性，称为治疗指数（TI）。治疗指数越大药物相对越安全。